等标污染负荷所采用的评价标准是
A. 大气环境质量标准
B. 污染物排放标准
C. 大气卫生标准
D. 地表水环境质量标准
E. 地面水卫生标准

正确答案：B。污染物排放标准

解析：本题考查等标污染负荷所采用的评价标准。等标污染负荷是把i污染物的排放量稀释到其相应排放标准时所需的介质量。它所采用的评价标准是污染物排放标准（B对ACDE错）。